体现不伤害原则的是
A. 杜绝对病人的有意伤害
B. 选择受益最大、损伤最小的治疗方案
C. 患者及家属无法实行知情同意时医生可以行使家长权
D. 对病人一视同仁
E. 合理筛选肾脏移植受术者

正确答案：A。杜绝对病人的有意伤害

解析：在医学实践中，不伤害是指在诊治、护理过程中不使患者的身心受到损伤。掌握“医学伦理的基本原则”知识点。